牙髓缓慢充血，髓角有脓肿形成，脓肿周围常有肉芽组织包绕，而其余牙髓组织正常，属于以下哪种牙髓炎
A. 慢性闭锁性牙髓炎
B. 慢性溃疡性牙髓炎
C. 溃疡型慢性增生性牙髓炎
D. 上皮型慢性增生性牙髓炎
E. 牙髓网状变性

正确答案：A。慢性闭锁性牙髓炎

解析：本题考查急、慢性牙髓炎。慢性闭锁性牙髓炎（A对）的病理变化中机体抗力弱而刺激较强时，牙髓充血，在髓角处可有脓肿形成，脓肿周围常有肉芽组织包绕，而其余牙髓组织正常。